选择性抑制环氧酶-2（COX-2）的药物是
A. 阿司匹林
B. 布桂嗪
C. 塞来昔布
D. 秋水仙碱
E. 丙吡胺

正确答案：C。塞来昔布

解析：本题考查选择性抑制COX-2的药物。塞来昔布（C对）选择性抑制COX-2而产生抗炎作用；阿司匹林（A错）为非选择性环氧酶抑制剂；布桂嗪（B错）为镇痛药，具有成瘾性；秋水仙碱（D错）为选择性抗痛风关节炎药、丙吡胺（E错）属Ia类抗心律失常药，两者均不属于环氧酶抑制剂。